关于IL-2的生物学效应，错误的是
A. 以自分泌方式发挥作用
B. 促进T细胞增殖分化
C. 抑制Thl细胞分泌IFN-γ
D. 增强NK细胞的杀伤活性
E. 促进B细胞增殖分化

正确答案：C。抑制Thl细胞分泌IFN-γ

解析：IL-2为Th1细胞分泌的细胞因子，以自分泌方式发挥作用（A对），促进T细胞和B细胞增殖分化（BE对），同时可明显促进NK细胞对病毒感染细胞的杀伤作用（D对）。Th1细胞因子和Th2细胞因子是相互拮抗的，IFN-γ抑制Th2细胞的功能，故而对Th1细胞的功能是促进的，抑制Thl细胞分泌IFN-γ的细胞因子为IL-4（C错，为本题正确答案）。